黏液表皮样癌最不容易发生的部位是
A. 腮腺
B. 腭腺
C. 磨牙后腺
D. 颌骨
E. 颊腺

正确答案：D。颌骨

解析：黏液表皮样癌90%发生于腮腺，下颌下腺及舌下腺少见；小唾液腺最常见于腭部，其次为磨牙后腺、舌腺、唇腺和颊腺；极少数发生于颌骨内。掌握“黏液表皮样癌”知识点。